一般用于对颌模型印模制取的是
A. 琼脂类
B. 藻酸盐类
C. 聚醚橡胶类
D. A型硅橡胶
E. 缩合型硅橡胶

正确答案：B。藻酸盐类

解析：藻酸盐类：印模表面清晰度和尺寸稳定性较差，质量不佳。一般只能用于对颌模型和研究模型印模的制取。掌握“暂时冠及印模与模型”知识点。